患者排便时肛内脱出肿物，为耳状红色粘膜皱襞，长3-5cm，触之柔软，无弹性，便后能自行回纳，不易出血，其诊断是
A. 二期内痔
B. 三期内痔
C. 一度直肠脱垂
D. 二度直肠脱垂
E. 三度直肠脱垂

正确答案：C。一度直肠脱垂

解析：内痔分度：I度：便时带血，滴血或喷射状出血，便后出血可自行停止，无痔脱出。II度：常有便血，排便时有痔脱出，便后可自行回纳。（A错）III度：偶有便血，排便或久站、咳嗽、劳累、负重时痔脱出，需用手还纳。（B错）IV度：偶有便血，痔脱出不能还纳，多伴有感染、水肿、糜烂和坏死，疼痛剧烈。直肠脱垂分度：一度脱垂：为直肠粘膜脱出，脱出物淡红色，长3~5cm，触之柔软，无弹性；不易出血，便后可自行回纳。（C对）二度脱垂：为直肠全层脱出，脱出物长5~10cm，呈圆锥状，淡红色，表面为环状而有层次的粘膜皱襞，触之较厚，有弹性，肛门松弛，便后有时需用手回复。（D错）三度脱垂：直肠及部分乙状结肠脱出，长达10cm以上，呈圆柱形，触之很厚，肛门松弛无力。（E错）